持续几天、几周或几个月的疾病流行或疫情暴发是
A. 疾病的季节性
B. 季节的周期性
C. 季节的长期变异
D. 季节的短期波动
E. 疾病暴发后的余波

正确答案：D。季节的短期波动

解析：本题考查短期波动的概念。短期波动（D对ABCE错）一般是指持续几天、几周或几个月的疾病流行或疫情暴发。